最常见的子宫肌瘤变性是
A. 囊性变
B. 玻璃样变
C. 红色变
D. 肉瘤变
E. 钙化

正确答案：B。玻璃样变

解析：最常见的子宫肌瘤变性是玻璃样变（B对）。其他常见的子宫肌瘤变性有：囊性变（A错）、红色变（C错）、肉瘤变（D错）、钙化（E错）。